极易发霉的饮片是
A. 秦艽
B. 莪术
C. 桔梗
D. 柴胡
E. 独活

正确答案：E。独活

解析：本题考查的是中药饮片贮存中常见的质量变异现象。极易发霉的饮片是独活（E对）。霉变：是指饮片受潮后在适宜温度条件下，引发寄生在其表面或内部的霉菌大量繁殖，导致发霉的现象。霉变对饮片的危害仅次于虫蛀。我国地处温带，特别是长江以南地区，夏季炎热、潮湿，饮片最易发霉。霉变饮片不能再供药用。当霉菌在潮湿的环境下，遇到适宜的温度（20～35℃），即可萌发菌丝，并分泌酵素，侵蚀饮片组织内部，使其腐烂变质、气味走失，而且有效成分也遭到很大的破坏，以致不能药用。凡含有糖类、黏液质、淀粉、蛋白质及油类的饮片较易霉变，如牛膝、天冬、马齿苋、菊花、蕲蛇、五味子、人参、独活、紫菀等。此外中药鲜药因含水量较多，也容易发生霉变。莪术（B错）、桔梗（C错）与柴胡（D错）均为易生虫饮片。易生虫饮片：党参、人参、南沙参、冬虫夏草、当归、独活、白芷、防风、板蓝根、甘遂、生地、泽泻、全瓜蒌、枸杞子、大皂角、桑葚、龙眼肉、核桃仁、莲子、薏苡仁、杏仁、青风藤、桑白皮、鹿茸、蕲蛇、鸡内金、菊花、金银花、凌霄花、北沙参、防己、莪术、川贝母、金果榄、佛手、陈皮、砂仁、酸枣仁、红花、闹羊花、蒲黄、芫花、蝉蜕、黄柏、狗肾、地龙、甘草、黄芪、山药、天花粉、桔梗、灵芝、猪苓、茯苓、水蛭、僵蚕、蜈蚣、乌药、葛根、丹参、何首乌、赤芍、苦参、延胡索、升麻、萆薢、大黄、肉豆蔻、淡豆豉、柴胡、地榆、川芎、半夏、玉竹。秦艽（A错）的质量变异现象，2022年考试指南未明确说明。